在全球疾病负担中排首位的精神障碍是
A. 抑郁症
B. 阿尔茨海默病
C. 焦虑症
D. 精神分裂症
E. 强迫症

正确答案：A。抑郁症

解析：在疾病负担（DALYs）＞1％（也即疾病负担较高）的25种疾病中，精神疾病占5项，分别是：抑郁症6.2％（最高）（A对），自杀（伤）3.9％，双相情感疾病1.8％，精神分裂症1.3％（D错），强迫症1.1％（E错）。预测2020年，GBD认为中国人的疾病谱将有很大改变，居疾病负担前5位的是：慢性肺梗塞、脑血管病、抑郁症、车祸、冠心病和自杀（伤）（并列第5位）。